患者，男，63岁，2型糖尿病病史20年，现服用二甲双胍0.5g，一日3次；阿卡波糖0.1g，一日3次；罗格列酮4mg，一日1次。既往高血压病史5年，冠心病病史5年，心功能Ⅰ级，轻度肾功能不全，长期服用贝那普利、阿司匹林。患者用药一段时间后出现冠心病加重，夜间憋喘，活动困难，诊断为“冠心病，心功能Ⅲ级”。此时应停用的药物是
A. 二甲双胍
B. 阿卡波糖
C. 贝那普利
D. 罗格列酮
E. 阿司匹林

正确答案：D。罗格列酮

解析：本题考查口服降糖药的作用特点。罗格列酮（D对）为胰岛素增敏剂类降糖药，有心力衰竭（心功能Ⅱ级以上）、活动性肝病或转氨酶升高超过正常上限2.5倍以及严重骨质疏松和骨折病史的患者应禁用此类药。患者用药一段时间后的出现冠心病加重，夜间憋喘，活动困难，诊断为“冠心病，心功能Ⅲ级”，此时应停用罗格列酮。